某地区某病发病率显著超过该病历年发病率水平，此描述属于何种流行强度
A. 散发
B. 暴发
C. 流行
D. 大流行
E. 大暴发

正确答案：C。流行